X线胸片中，有总密集度1级的小阴影，分布范围达到2个肺区，属于（）期尘肺
A. Ⅱ
B. Ⅰ
C. 0
D. Ⅲ

正确答案：B。Ⅰ

解析：本题考查尘肺Ⅰ期诊断标准。有下列表现之一者可诊断为尘肺Ⅰ期（B对ACD错）：①有总体密集度Ⅰ级的小阴影，分布范围至少达到2个肺区；②接触石棉粉尘，有总体密集度1级的小阴影，分布范围只有1个肺区，同时出现胸膜斑；③接触石棉粉尘，小阴影总体密集度为0，但至少有两个肺区小阴影密集度为0/1，同时出现胸膜斑。